亡血家不可发汗，其理论根据是
A. 气能行血
B. 津血同源
C. 气能生血
D. 气能行津
E. 津能载气

正确答案：B。津血同源

解析：血可化津，血液由营气和津液构成。血行脉中，血中之津液可渗出脉外而为脉外之津液。若失血过多，脉中血少，脉外津液进入脉中以维持血量，可引起脉外津液不足。因此，对于失血者应慎用发汗等方法治疗，以防进一步耗伤律液（B对）。气能行血，指气具有推动血液在脉中运行的作用（A错）；气能生血指气参与并促进血液的生成（C错）；气能行津指气具有推动津液输布和排泄的作用（D错）；津能载气指津液是气的载体之一。在血脉之外，气的运行依附于津液（E错）。